引起乌头类药物中毒的常见原因有
A. 生用
B. 皮肤接触
C. 过量服用
D. 煎煮时问太短
E. 与酒同用

正确答案：A、C、D、E。生用；过量服用；煎煮时问太短；与酒同用

解析：本题考查的是乌头类药物的中毒原因。引起乌头类药物中毒的常见原因有生用（A对）、过量服用（C对）、煎煮时间太短（D对）或与酒同用（E对）。乌头类药物的中毒原因：1.过量服用为主要原因。2.用法不当，如煎煮时间太短或生用。3.泡酒服用。4.个体差异引起蓄积性中毒。皮肤接触（B错）能引起中毒的中药为马钱子。马钱子有毒成分能经皮肤吸收，外用不宜大面积涂敷。